下列有关Garre＇骨髓炎描述正确的是
A. 好发于老年人
B. 病程发展迅速
C. 上颌骨比下颌骨多见
D. 表面黏膜和皮肤色泽红肿
E. 又称慢性骨髓炎伴增生性骨膜炎

正确答案：E。又称慢性骨髓炎伴增生性骨膜炎

解析：慢性骨髓炎伴增生性骨膜炎又称为Garre＇骨髓炎，是一种伴明显骨膜炎症反应的慢性骨髓炎亚型。多由于慢性根尖周炎、牙周炎或拔牙创感染的持续存在，通过密质骨刺激骨膜，导致骨膜下反应性新骨形成。好发于青少年，下颌骨比上颌骨多见，特别是下颌后区。表现为无痛性颌骨肿胀，质地坚硬，表面黏膜和皮肤色泽正常。病程发展缓慢。X线表现为特征性的密质骨的肥厚，在骨密质外有不规则的骨质增生，形成双层或多层骨密质，骨髓腔内可有点状破坏。掌握“Garré骨髓炎及致密性骨炎”知识点。